患者胸胁胀满，性情急躁，经行腹痛，经色紫暗，乳房胀痛，证属
A. 气滞
B. 气虚血滞
C. 血瘀阻络
D. 寒客血脉
E. 肝郁气滞血瘀

正确答案：E。肝郁气滞血瘀

解析：本题考查的是肝气郁结证与气滞血瘀证的临床表现。患者胸胁胀满，性情急躁，经行腹痛，经色紫暗，乳房胀痛，证属肝郁气滞血瘀（E对）。肝气郁结证临床表现，常见胁肋胀痛，胸闷不舒，善太息，神情沉默，不欲饮食，或见口苦善呕，头目眩晕，脉弦，舌苔白滑。在妇女则有月经不调、痛经或经前乳房作胀等症。气滞血瘀证的临床表现，常见胸胁胀满走窜疼痛，性情急躁，并兼见痞块刺痛拒按，舌紫暗或有瘀斑等。妇女还可见月经闭止，或痛经、经色紫暗有块，乳房胀痛等症状。气滞（A错）证的临床表现，常见胀闷疼痛，妇女乳房胀痛。气虚血滞（B错）可同见气虚证与血瘀证的临床表现，血瘀阻络（C错）可见血瘀证的临床表现。气虚证的临床表现，常见头晕目眩，少气懒言，疲倦乏力，自汗，活动时诸症加剧，舌淡，脉虚无力。血瘀证的临床表现，常见局部肿胀疼痛，痛如针刺，拒按，痛处固定不移，且常在夜间加重，一般伴有面色晦暗、口唇色紫、舌有瘀斑、口干但欲漱水不欲咽等症状。寒客血脉（E错），则气血凝滞，血脉挛缩，可见头身疼痛、脉紧。